梅毒的病原体是
A. 人乳头瘤病毒
B. 苍白密螺旋体
C. 单纯疱疹病毒
D. 革兰阴性双球菌
E. 钩端螺旋体

正确答案：B。苍白密螺旋体

解析：梅毒的病原体是苍白密螺旋体（B对）。人类乳头瘤病毒（HPV）（A错）主要引起人类皮肤黏膜的增生性病变，其中高危性HPV（16型、18型等）与子宫颈癌等恶性肿瘤的发生密切相关，低危性HPV（6型、11型等）引起生殖器尖锐湿疣（P316）。单纯疱疹病毒（HSV）（C错）可致导致口、唇、生殖器疱疹等多种疾病，如龈口炎、角膜结膜炎、新生儿感染（P295-P296）。革兰阴性双球菌（D错）即淋病奈瑟菌，是引起人类泌尿生殖系统粘膜化脓性感染的病原菌（P105）。钩端螺旋体（E错）是钩端螺旋体病的病原体（P198）。